流行病学数学模型属于
A. 流行病学的观察法
B. 流行病学的实验法
C. 流行病学的理论与方法学研究
D. 统计分析法
E. 基础实验法

正确答案：C。流行病学的理论与方法学研究

解析：本题考查流行病学研究方法的分类。流行病学数学模型属于流行病学理论与方法学的研究（C对ABDE错），即数理法。